前列腺是呈前后略扁栗子形的腺体，为重要的生殖管道附属腺，男性尿道从其实质中穿过。关于前列腺形态的描述，正确的是
A. 底向下，尖向上
B. 位于盆膈之上
C. 内有尿道膜部经过
D. 可分为前、中、后3叶
E. 发生增生时可引起排尿困难

正确答案：E。发生增生时可引起排尿困难

解析：前列腺为底向上，尖向下（A错）。内有尿道前列腺部（C错）经过。前列腺分为五叶（D错）：前叶、中叶、后叶和两侧叶。发生增生时可引起排尿困难甚至尿潴留（E对）。